医疗机构施行特殊治疗时
A. 可以由经治医生决定施行
B. 可以由本科在科主任主持下讨论决定施行
C. 由医院决定施行
D. 可以征求患者意见
E. 必须征得患者同意

正确答案：E。必须征得患者同意

解析：医疗机构施行特殊治疗时必须征得患者同意。并应当取得其家属或者关系人容易并签字后才能实施。掌握“医疗机构概述及机构执业”知识点。